提出要使精神病患者得到康复，除了不受束缚外，他们应该从事有益的劳动的是
A. 皮纳尔医生
B. 白求恩医生
C. 奈塞尔博士
D. 梅兰克森博士
E. 皮亚杰心理学家

正确答案：A。皮纳尔医生

解析：1792年皮纳尔（P.Pinel）医生提出要使精神病患者得到康复，除了不受束缚外，他们应该从事有益的劳动。人们要以关心的态度来倾听他们的诉说，并且在他所管辖的精神病院中迈出了解放患者的第一步。这是从如何认识精神病和给患者以人道主义待遇开始的当代心理卫生运动的起点。掌握“心理健康概述”知识点。